属于第一信使的是
A. cGMP
B. Ca²⁺
C. cAMP
D. 肾上腺素
E. 转化因子

正确答案：D。肾上腺素

解析：本题考查第一信使。属于第一信使的是肾上腺素（D对）。第一信使是指多肽类激素、神经递质及细胞因子及药物等细胞外信使物质。cGMP（A错）、Ca²⁺（B错）、cAMP（C错）均为第二信使。转化因子（E错）为第三信使。